细菌性感染性腹泻禁用的是
A. 胃蛋白酶
B. 多潘立酮
C. 洛哌丁胺
D. 乳果糖
E. 伪麻黄碱

正确答案：C。洛哌丁胺

解析：本题考查药物的禁忌症。细菌性感染性腹泻禁用的是洛哌丁胺（C对）。洛哌丁胺能抑制肠蠕动和收缩，可用于非感染性的急、慢性腹泻。不能作为有发热、便血的细菌性痢疾的治疗，不应用于不需抑制肠蠕动抑制的病人，尤其是肠梗阻、亚肠梗阻或便秘病人。胃蛋白酶（A错）禁用于胃肠道出血患者。多潘立酮（B错）为促胃肠动力药，禁用于嗜铬细胞瘤、乳癌、机械性肠梗阻、胃肠出血患者。乳果糖（D错）禁用于乳酸血症患者。伪麻黄碱（E错）是α受体激动剂，α受体激动剂能收缩平滑肌，即能收缩膀胱颈，从而加重膀胱颈梗阻，故膀胱颈梗阻禁用伪麻黄碱。